患者，女，26岁，已婚。停经2个月，尿妊娠试验阳性，恶心呕吐10天，加重4天，不能进食，呕吐血水，精神萎靡，头晕体倦，舌红，苔薄黄而干，脉细滑无力。其证候是
A. 肝胃不和
B. 气阴两虚
C. 脾胃虚弱
D. 痰湿内阻
E. 肝脾不和

正确答案：B。气阴两虚

解析：患者停经2个月，尿妊娠试验阳性，恶心呕吐10天，故诊断为恶阻。不能进食，呕吐血水，精神萎靡，头晕体倦可知为妊娠恶阻重症，为久病未愈，呕吐日久所致。舌红，苔薄黄而干，脉细滑无力为气阴两虚之象，故辨为气阴两虚证。肝胃不和证见恶心，呕吐酸水或苦水，口干口苦，头胀而晕，胸满胁痛，嗳气叹息的症状（A错）。题中患者诊断为妊娠恶阻气阴两虚证（B对）。脾胃虚弱证见恶心呕吐不食，甚则食入即吐，呕吐清涎，头晕肢倦，脘痞腹胀的症状（C错）。题中无痰湿的征象，妊娠恶阻亦无痰湿内阻证（D错）。肝脾不和以肝失疏泄，脾失健运为特征，且妊娠恶阻无肝脾不和证（E错）。